属证的是
A. 发热恶寒
B. 肝胃不合
C. 胸胁胀满
D. 纳呆食少
E. 头身疼痛

正确答案：B。肝胃不合

解析：本题考查的是症、证、病的区别。属证的是肝胃不合（B对）。症，指疾病的外在表现，即症状。病，即疾病的简称，指有特定的致病因素、发病规律和病机演变的异常生命过程，具有特定的症状和体征。所谓“证”，是机体在疾病发展过程中某一阶段的病机概括，包括病变的部位、原因、性质以及邪正关系，能够反映出疾病发展过程中某一阶段的病机变化的本质，因而它比症状能更全面、更深刻、更准确地揭示出疾病的发展过程和本质。肝胃不和为证，胸胁胀满（C错）为其症状。肝胃不和证的临床表现，常见胸胁胀满，善太息，胃脘胀满作痛，嗳气吞酸，嘈杂或呕恶，苔薄黄，脉弦。发热恶寒（A错）与头身疼痛（E错）为表证的主要症状。表证，指的是病位浅在肌肤的一类证候。一般是指六淫之邪从皮毛、口鼻侵入人体而引起的外感病初起阶段。其临床表现以发热恶寒，或恶风，舌苔薄白，脉浮为主。常兼见头身疼痛、鼻塞、咳嗽等症状。以起病急、病程短、有发热恶寒的症状为辨证要点。纳呆食少（D错）为心悸心脾两虚证的症状。心悸心脾两虚证：【症状】心悸气短，头晕目眩，失眠健忘，面色无华，倦怠乏力，纳呆食少。舌淡红，脉细弱。【治法】补血养心，益气安神。【方剂应用】基础方剂为归脾汤（人参、黄芪、白术、茯神、龙眼肉、酸枣仁、木香、当归、远志、甘草、生姜、大枣）加减。【中成药应用】常用中成药有人参归脾丸（大蜜丸）、复方扶芳藤合剂、益气养血口服液、消疲灵颗粒。